眼眶骨折临床表现除外的是
A. 骨折移位
B. 眼球外凸
C. 复视
D. 眶周淤血、肿胀
E. 眶下区麻木

正确答案：B。眼球外凸

解析：眼眶骨折临床表现：①骨折移位；②眼球内陷；③复视；④眶周淤血、肿胀；⑤眶下区麻木。掌握“颧骨及颧弓、眼眶骨折及骨折愈合过程”知识点。